卫生法的立法宗旨和最终目的是
A. 预防为主
B. 中西医并重
C. 保护公民健康
D. 动员全社会参与
E. 卫生工作法制化

正确答案：C。保护公民健康

解析：卫生法的立法宗旨和最终目的是增进个人和社会健康、均衡个人和社会健康，即保护公民健康（C对）。